以下哪项不是猩红热的并发症
A. 化脓性中耳炎
B. 类风湿关节炎
C. 急性肾小球肾炎
D. 中毒性关节炎
E. 蜂窝组织炎

正确答案：B。类风湿关节炎

解析：猩红热的并发症较多，主要有三类：化脓性并发症，由于感染乙型溶血性链球菌和其它的化脓菌，从原发的咽、扁桃体部向附近扩散蔓延，引起颈及颌下淋巴结炎、颈部蜂窝组织炎（E对）、化脓性中耳炎（A对）、乳突炎、鼻窦炎等；中毒性并发症，是由乙型溶血性链球菌释放的外毒素造成的，如中毒性关节炎（D对）、心肌炎等；变态反应并发症，由于乙型溶血性链球菌及其毒素在某些特殊体质人的体内，同身体里的抗体产生了不正常的过敏反应，这种反应损害了人体的某些器官，引起风湿热、急性肾炎（C对）、反应性关节炎等。类风湿关节炎是一种病因未明的慢性、以炎性滑膜炎为主的系统性疾病，发病与乙型溶血性链球菌无关，故不是猩红热的并发症（B错，为本题正确答案）。